6月龄至2岁婴幼儿腹泻最重要的病原体
A. A组轮状病毒
B. C组轮状病毒
C. D组轮状病毒
D. F组轮状病毒
E. G组轮状病毒

正确答案：A。A组轮状病毒

解析：轮状病毒分为7个组（A～G），A～C组轮状病毒能引起人类和动物腹泻，D～G组只能引起动物腹泻。A组轮状病毒感染最为常见，它是6月龄至2岁婴幼儿腹泻的最重要的病原体。掌握“胃肠道病毒”知识点。